外侧膝状体
A. 属背侧丘脑的结构
B. 是听觉通路上的中继站
C. 接收视束传入的纤维
D. 发出纤维投射至颞横回
E. 接收下丘臂的纤维

正确答案：C。接收视束传入的纤维

解析：后丘脑（A错）包括内侧膝状体和外侧膝状体。内侧膝状体是听觉通路上的中继站（B错），接受下丘臂的听觉纤维（E错），发出纤维投射至颞横回（D错）的听觉中枢；外侧膝状体是视觉通路上的中继站，接受视束传入的纤维（C对），发出纤维投射至枕叶的视觉中枢。